女，28岁。持续胸痛1天，深吸气时加重。心电图：除aVR外的其他导联ST段呈弓背向下抬高。该患者最可能的诊断是
A. 急性胸膜炎
B. 急性肺栓塞
C. 变异型心绞痛
D. 急性心肌梗死
E. 急性心包炎

正确答案：E。急性心包炎

解析：患者青年女性，持续胸痛，深吸气时加重（急性心包炎常见的表现），心电图示除aVR外的其他导联ST段呈弓背向下抬高（急性心包炎特征性心电图表现），综合患者的临床表现和心电图检查，该患者最可能的诊断是急性心包炎（E对）。急性胸膜炎（A错）表现为胸痛，由于呼吸时胸膜的摩擦，胸痛呈吸气明显，屏气消失的特点，一般无心电图变化。急性肺栓塞（P100）（B错）常表现为突然出现的呼吸困难、胸痛、咯血甚至晕厥等症状。变异型心绞痛（P229）（C错）多于静息情况下发生，一般不会出现持续性胸痛，心电图表现为一过性ST段抬高。急性心肌梗死（P236）（D错）常表现为胸骨后压榨性疼痛，心电图特征性表现为对应导联的ST段呈弓背向上（不是弓背向下）抬高，且常伴宽而深的Q波。